口腔黏膜各部对触压觉的敏感度不同，最敏感的部位和较迟钝的部位分别是
A. 舌根，软腭最敏感，牙根，舌背较迟钝
B. 舌尖，软腭最敏感，颊肌，硬腭较迟钝
C. 舌尖，硬腭前部最敏感，颊、舌背较迟钝
D. 舌的各部分
E. 以上都不是

正确答案：C。舌尖，硬腭前部最敏感，颊、舌背较迟钝

解析：口腔黏膜表面对触压觉的敏感度与该处触压点分布的密度成正比。口腔黏膜各部对触压觉的敏感度不同：最敏感者为舌尖、唇及硬腭前部，较迟钝者为颊、舌背和牙龈。龈乳头、腭皱襞处触点的分布多于痛点的分布。年龄愈大，黏膜角化愈高，口腔黏膜对触压觉的敏感度越低。掌握“口腔感觉”知识点。